新生儿期的保健要点不包括
A. 保暖
B. 喂养
C. 护理
D. 足量饮水
E. 预防感染

正确答案：D。足量饮水

解析：本题考查新生儿的保健要点。新生儿不需要足量饮水（D错，为本题正确答案），奶量足够即可，无论乳汁还是奶粉水量都是足够的。新生儿期的保健要点：（1）环境温度：新生儿要注意保暖（A对），防止着凉；（2）喂养（B对）：尽早吸吮母乳，指导母亲正确的哺乳方法；（3））护理（C对）：新生儿皮肤娇嫩，保持皮肤清洁和干燥；选择合适的衣服、尿布或纸尿裤；（4）促进感知觉、运动发育；（5）预防感染（E对）：新生儿居室保持空气新鲜；避免交叉感染；新生儿的用具每日煮沸消毒等；（6）伤害预防 ：注意喂哺姿势、喂哺后的体位，预防乳汁吸入和窒息，预防意外伤害的发生。